2岁女孩，发热、咳嗽、气促1周，查体：精神不振，面色苍白，呼吸困难，皮肤可见荨麻疹样皮疹，双肺可闻及细湿啰音，X线检查显示多发性小脓肿，易变。首先考虑诊断为
A. 革兰阴性杆菌肺炎
B. 肺炎支原体肺炎
C. 腺病毒肺炎
D. 呼吸道合胞病毒肺炎
E. 葡萄球菌肺炎

正确答案：E。葡萄球菌肺炎

解析：葡萄球菌所致肺炎，患儿可出现面色苍白，烦躁不安，咳嗽，呻吟，呼吸困难，肺部体征出现较早，双肺可闻及中、细湿罗音，可合并循环、神经及消化系统功能障碍。皮肤常见猩红热或荨麻疹样皮疹。胸部X线特点：临床症状与胸片所见不一致；病变发展迅速，小片炎症就可发展成脓肿；病程中，多合并小脓肿、脓气胸、肺大疱；病灶阴影持续时间较长。根据患儿发病年龄、皮肤特点、胸片结果及其他症状体征，故诊断为葡萄球菌肺炎（E对）。革兰阴性杆菌肺炎（A错）临床表现为发热，精神萎靡，嗜睡，咳嗽，呼吸困难，面色苍白。胸部X线特点因菌种差异而不同；病理改变以肺内浸润、实变、出血性坏死为主。肺炎支原体肺炎（B错）多见于年长儿，发热、咳嗽、咯痰为主要症状；肺部体征因年龄而异，年长儿大多缺乏显著的肺部体征，婴幼儿叩诊呈浊音，听诊呼吸音减弱；胸部X线特点：多表现为单侧病变，以右肺中下野多见；呈双侧弥漫网状或结节样浸润阴影或间质性肺炎表现。体征轻微而胸片阴影显著为本病特征之一。腺病毒肺炎（C错）多见于6个月～2岁的婴幼儿；发热、咳嗽、呼吸困难为主要症状；重症者可出现鼻翼煽动、三凹征、喘憋及口唇甲床青紫；肺部体征出现较晚，发热4～5日后方可闻及湿啰音；胸部X线特点：大小不等的片状阴影或融合成大病灶；肺部X线改变较肺部啰音出现早。呼吸道合胞病毒肺炎（D错）多见于1岁以内，发热、咳嗽、喘憋为主要症状；咳嗽大多为干咳。中、重症病儿有喘憋，呼吸困难，出现呼吸增快、三凹征、鼻翼煽动及口唇发绀；肺部听诊可闻及哮鸣音、呼吸性喘鸣、有时伴呼吸音减弱，肺基底部可听到细湿啰音；胸部X线特点：毛细支气管炎常有不同程度梗阻性肺气肿和支气管周围炎；间质性肺炎可呈线条状或单条状阴影增深，或互相交叉成网状阴影，多伴有小点状致密阴影。